一般不宜使用糖皮质激素类药物的疾病为
A. 败血症
B. 过敏性休克
C. 支气管哮喘
D. 腮腺炎
E. 多发性心肌

正确答案：D。腮腺炎

解析：腮腺炎（D错，为本题正确答案）属于病毒性感染，病毒性感染一般不用糖皮质激素，用后可能使机体防御能力下降反而使感染病灶扩散而恶化。糖皮质激素属于肾上腺激素类药，生理剂量下主要影响物质代谢过程，超生理剂量除影响物质代谢外，还具有抗炎、免疫抑制、抗休克等药理作用，可短期用于中毒性感染或同时伴有休克者，如中毒性痢疾、中毒性肺炎、败血症等（A对）。糖皮质激素可用于各种休克，有助于度过危险期，对过敏性休克，起效慢，应先采用肾上腺素，随后合用糖皮质激素（B对）。糖皮质激素具有免疫抑制作用，临床可用于自身免疫性疾病、过敏性疾病和器官移植，对过敏性疾病支气管哮喘（C对）可抑制气道炎症过程，缓解症状。对于多发性心肌炎，早期使用糖皮质激素可减轻炎症渗出，减轻粘连及疤痕形成而引起的功能障碍，防止多发性心肌炎的后遗症（E对）。